男，38岁。外伤后双下肢瘫痪，双上肢肌张力和肌力正常，双下肢肌力2级，双侧膝踝反射亢进。其受损的部位是
A. 传入神经元
B. 前角
C. 胸段脊髓
D. 颈段脊髓
E. 腰段脊髓

正确答案：C。胸段脊髓

解析：患者有外伤史，双上肢肌张力和肌力正常（说明损伤部位在颈膨大以下），双下肢肌力2级、双侧膝踝反射亢进（说明支配下肢肌群的神经元失去上位神经的支配，损伤部位在腰膨大以上），故该患者受损部位是胸段脊髓（C对）（关于脊髓主要节段横贯性损伤的临床表现现总结如下：颈膨大以上（C1～4）：四肢呈痉挛性瘫痪；颈膨大以下（C5～T12）：两上肢呈弛缓性瘫痪，两下肢呈痉挛性瘫痪；腰膨大以下（L1～S2）：双下肢弛缓性瘫痪；脊髓圆锥（S3～5和尾节）：肛门周围和会阴部感觉消失，呈鞍状分布，肛门反射消失，性功能障碍；马尾神经根：症状和体征可为单侧或不对称，下肢可有弛缓性瘫痪，括约肌障碍不明显）。传入神经元（A错）或前角（B错）受损，则膝踝反射反射弧遭到破坏，双侧膝踝反射应消失。颈段脊髓（D错）损伤表现为四肢瘫，上颈椎损伤表现为四肢痉挛性瘫痪，下颈椎损伤时上肢表现为弛缓性瘫痪，下肢为痉挛性瘫痪。腰段脊髓（E错）损伤时，下肢弛缓性瘫痪反射减弱或消失而非亢进。